下列各项，不属于胎儿生长受限的中医证型是
A. 肾气亏虚
B. 阴虚内热
C. 气血虚弱
D. 脾虚湿盛
E. 胞宫虚寒

正确答案：D。脾虚湿盛

解析：胎儿生长受限主要发病机制是父母禀赋虚弱，或孕后房事不节，损伤肾气（A对），则胎失所长；素体气血不足（C对），则胎失所养；素体阴虚（B对）或久病失血伤阴，则胎失所养而不长；素体阳气不足，或孕后过食寒凉生冷，致胞宫虚寒（E对），可使胎失温养，胎萎不长（D错，为本题正确答案）。